《药品注册管理办法》规定未曾在中国境内上市销售药品的注册申请是
A. 新药申请
B. 进口药品申请
C. 补充申请
D. 已有国家标准药品的申请
E. 药品生产申请

正确答案：A。新药申请

解析：本题考查新药。《药品注册管理办法》规定未曾在中国境内上市销售药品的注册申请是新药申请（A对）。新药是指未曾在中国境内上市销售的药品，包括国内外均未曾上市的创新药（首次作为药用物质的新化合物）和国外已上市但未曾在我国境内上市销售的药品。